加味保和丸既能健胃理气，又能
A. 健脾消食
B. 行气消痞
C. 行气利水
D. 利湿和中
E. 通络止痛

正确答案：D。利湿和中

解析：本题考查加味保和丸的功能。加味保和丸既能健胃理气，又能利湿和中（D对）。加味保和丸【功能】健胃理气，利湿和中。健脾消食丸【功能】健脾，和胃，消食（A错），化滞。香砂枳术丸【功能】健脾开胃，行气消痞（B错）。槟榔四消丸【功能】消食导滞，行气利水（C错）。通心络胶囊【功能】益气活血，通络止痛（E错）。